X线片显示髓腔内有局限性不规则的膨大透影区域为
A. 牙髓坏死
B. 牙髓钙化
C. 牙内吸收
D. 急性牙髓炎
E. 慢性根尖周炎

正确答案：C。牙内吸收

解析：本题考查牙髓坏死、牙髓钙化与牙内吸收。牙内吸收（C对）X线片显示髓腔内有局限性不规则的膨大透影区域，严重者可见吸收区穿通髓腔壁，甚至出现牙根折断线。